某城市发生儿童铅中毒，他们很有可能同时患有
A. 佝偻病
B. 贫血
C. 脚气病
D. 癞皮病
E. 甲状腺肿

正确答案：A。佝偻病

解析：本题考查铅中毒的相关内容。铅中毒时，血浆中的铅可形成磷酸氢铅，数周后形成稳定的磷酸铅，沉积于骨，骨铅的半减期为2～10年，影响骨骼，导致钙、磷代谢失调和骨骼改变。所以发生儿童铅中毒时，有可能同时患有佝偻病（A对BCDE错）。